下列属于严重烧伤患者康复治疗的是
A. 功能康复
B. 心理康复
C. 体能康复
D. 社会康复
E. 以上都是

正确答案：E。以上都是